中成药联用在临床上普遍存在，关于中成药合理联用的说法，正确的是
A. 脑立清胶囊与桂附地黄丸联用治疗高血压肝肾阴虚证前药为主后药为辅辅药能提高主药功效
B. 乌鸡白凤丸与香砂六君丸联用治疗月经不调后者可辅助前者增强养血调经之功
C. 二陈丸与平胃散联用治疗湿痰咳嗽两药功效相似可以起到增强疗效的协同作用
D. 内服六神丸与外用冰硼散联用治疗咽喉肿痛后者能够抑制前者的偏性
E. 舟车丸与金匮肾气丸联用治疗阳水后者能够明显消除前者的偏性

正确答案：B。乌鸡白凤丸与香砂六君丸联用治疗月经不调后者可辅助前者增强养血调经之功

解析：本题考查的是中成药之间的配伍应用。中成药联用在临床上普遍存在，关于中成药合理联用的说法，正确的是乌鸡白凤丸与香砂六君丸联用治疗月经不调后者可辅助前者增强养血调经之功（B对）。中成药之间的配伍应用：中成药之间的配伍应用为明清以来的历代医家广泛采用，如明·薛己以补中益气丸、六味地黄丸合用治疗气阴不足；清·叶天士用大补阴丸、水陆二仙丹、牡蛎全樱膏配伍同用治疗阴虚火旺、淋浊、早泄。由此可见中成药之间的配伍应用，自古以来就是临床应用中成药的主要形式之一。1.两种功效相似的中成药同用治疗一种病证，以起到增强疗效的协同作用。如附子理中丸与四神丸合用，可以增强温肾运脾、涩肠止泻的功效，治疗脾肾阳虚之五更泄泻。归脾丸与人参养荣丸同用，可明显增强补益心脾、益气养血、安神止痉的功效，治疗心悸失眠、眩晕健忘。脑立清胶囊（片）与六味地黄丸合用，用于高血压病证属肝肾阴虚、风阳上扰者（A错）。2.功效不同的中成药配伍同用，一药为主，一药为辅，辅药能够提高主药功效。例如以二陈丸燥湿化痰为主方治疗湿痰咳嗽，而脾为生痰之源，辅以平胃散同用，燥湿健脾，可明显增强二陈丸燥湿化痰之功（C错）。又如以乌鸡白凤丸为主药治疗妇女气血不足、月经失调，辅以香砂六君丸，以开气血生化之源，增强主药的养血调经之功。3.中成药配伍应用，其中一种药物能够明显抑制或消除另一种中成药的偏性或副作用。如二便不通、阳实水肿，可用峻下通水的舟车丸，但为使峻下而不伤正气，常配合四君子丸同用。又如用金匮肾气丸治疗肾虚作喘，但若久治不愈，阳损及阴，兼见咽干烦躁者，又当配麦味地黄丸、生脉散或参蛤散同用，以平调阴阳、纳气平喘，且防止金匮肾气丸燥烈伤阴，降低副作用（E错）。4.也有些中成药之间的配伍应用是因为部分疾病的治疗必须采用不同治疗方法。如妇女宫冷不孕，需内服艾附暖宫丸，外贴十香暖脐膏，共奏养血调经、暖宫散寒之效；咽喉肿痛，可内服六神丸，外用冰硼散吹喉，共奏清热解毒、消肿利咽之效（D错）。